氯丙嗪引起锥体外系反应是由于阻断
A. 结节漏斗通路中的D₂受体
B. 黑质纹状体通路中的D₂受体
C. 中脑边缘系中的D₂受体
D. 中脑皮质通路中的D₂受体
E. 中枢M胆碱受体

正确答案：B。黑质纹状体通路中的D₂受体